属于五加科的是
A. 木通
B. 通草
C. 大血藤
D. 鸡血藤
E. 钩藤

正确答案：B。通草

解析：本题考查的是通草的来源。属于五加科的是通草（B对）。通草：【来源】为五加科植物通脱木的干燥茎髓。木通（A错）：【来源】为本通科植物木通、三叶木通或白木通的干燥藤茎。大血藤（C错）：【来源】为木通科植物大血藤的干燥藤茎。鸡血藤（D错）：【来源】为豆科植物密花豆的干燥藤茎。钩藤（E错）：【来源】为茜草科植物钩藤、大叶钩藤、毛钩藤、华钩藤或无柄果钩藤的干燥带钩茎枝。